风寒感冒患者宜选用的中成药是
A. 羚翘解毒颗粒
B. 双黄连颗粒
C. 银翘解毒颗粒
D. 桑菊感冒颗粒
E. 感冒清热颗粒

正确答案：E。感冒清热颗粒

解析：本题考查的是感冒清热颗粒的主治。风寒感冒患者宜选用的中成药是感冒清热颗粒（E对）。感冒清热颗粒：【主治】风寒感冒，头痛发热，恶寒身痛，鼻流清涕，咳嗽咽干。双黄连颗粒（B错）：【主治】外感风热所致的感冒，症见发热、咳嗽、咽痛。银翘解毒颗粒（C错）：【主治】风热感冒，症见发热、头痛、咳嗽、口干、咽喉疼痛。桑菊感冒颗粒（D错）：【主治】风热感冒初起，头痛，咳嗽，口干，咽痛。羚翘解毒颗粒（A错）的主治，2022年考试指南未明确说明。